目前健康状况的评价主要采用
A. 生理学指标
B. 心理学指标
C. 客观指标
D. 主观指标
E. 社会学指标

正确答案：D。主观指标

解析：本题考查目前健康状况的评价方法。目前健康状况的评价主要采用主观指标（D对ABCE错），评价内容一般包括生理功能、心理功能、社会功能、主观判断与满意度等方面。